男，38岁。右上臂刀割伤3小时，查体：T36.9℃，P102次/分，BP120/70mmHg，双肺呼吸音清，未闻及干湿性啰音，心律齐，未闻及杂音，腹软，无压痛，右手小指及环指的小指半侧感觉明显减退，手指内收障碍。损伤的神经是
A. 肌皮神经
B. 正中神经
C. 尺神经
D. 腋神经
E. 桡神经

正确答案：C。尺神经

解析：患者右上臂刀割伤3小时，右手小指及环指的小指半侧感觉明显减退，手指内收障碍（提示有尺神经损伤），结合患者病史和临床表现，该患者损伤的神经为尺神经（C对）。肌皮神经（A错）损伤主要见于肱骨上中段骨折，表现为屈肘无力以及前臂外侧部分皮肤感觉的减弱。正中神经（B错）在腕部损伤主要表现为拇对掌功能障碍、“猿手”畸形和手的桡侧半感觉障碍。腋神经（D错）损伤主要见于肱骨外科颈骨折，其主干损伤后主要表现为臂不能外展、臂旋外力减弱、肩部及臂外侧区上1/3部皮肤感觉障碍。桡神经（E错）伸腕、 伸拇、伸指、前臂旋后障碍及手背桡侧（虎口区）感觉异常，典型的畸形是垂腕。